cAMP蛋白激酶A途径和DG蛋白激酶C途径的共同特点是
A. 由G蛋白介导
B. Ca²⁺可激活激酶
C. 磷脂酰丝氨酸可激活激酶
D. 钙泵可拮抗激酶活性
E. cAMP和DG均为小分子，故都可在胞液内自由扩散

正确答案：A。由G蛋白介导